胁痛的基本病机为
A. 湿热内蕴
B. 气滞血瘀
C. 肝郁气滞
D. 肝络失和
E. 以上都不是

正确答案：D。肝络失和

解析：胁痛的病理因素，不外乎气滞、血瘀、湿热三者。一般来说，胁痛初病在气，肝气郁滞，气机不畅则致胁痛；气滞日久，气不行血，则血行不畅，病变由气滞转为血瘀，或两者并见。气滞日久，易化火伤阴；饮食所伤，肝胆湿热所导致的胁痛，日久可耗伤阴液，导致肝阴耗伤。上述病变发展过程说明此病起初是由于肝络失和引起（D对）。